采用滴制法制备软胶囊的过程中，影响软胶囊质量的因素有
A. 胶液、药液的温度
B. 喷头的大小
C. 滴制的速度
D. 冷却液的种类
E. 冷却液的温度

正确答案：A、B、C、D、E。胶液、药液的温度；喷头的大小；滴制的速度；冷却液的种类；冷却液的温度

解析：本题考查滴制法制备软胶囊的影响因素。滴制过程中胶液和药液的温度（A对）、滴头大小（B对）、滴制速度（C对）、冷却液的种类（D对）与温度（E对）等因素均会影响软胶囊的质量。